胸膜顶的位置
A. 高于锁骨内1/3段上方2.5cm
B. 高于锁骨中点上方2.5cm
C. 高于锁骨中1/3段上方2.5cm
D. 高于锁骨外1/3段上方2.5cm
E. 无

正确答案：A。高于锁骨内1/3段上方2.5cm

解析：胸膜顶位于锁骨中、内1/3交界处上方约2.5cm（A对）。